“起于目外眦……下行耳后”的经脉是
A. 足阳明胃经
B. 足少阳胆经
C. 足太阳膀胱经
D. 手少阳三焦经
E. 手太阳小肠经

正确答案：B。足少阳胆经

解析：本题考查各经脉循行路线。足太阳膀胱经起于目内眦，至耳上角，入络脑（C错）。足阳明胃经起于鼻，入上齿，环口夹唇，循喉咙（B错）。足少阳胆脉，起于目锐眦，下耳后，入耳中，出耳前（B对）。手少阳三焦经系耳后，出耳上角，入耳中，至目锐眦（D错）。手太阳小肠经 ，至目内外眦，入耳中，抵鼻（E错）。记忆：表1-2，这个表非常重要，要牢记经脉与哪些器官联络